CD8⁺T细胞活化的第一信号是
A. TCR识别Ag肽-自身MHCⅠ类分子复合物
B. 协同刺激因子在靶细胞表面的表达
C. 表达IL-2受体
D. 表达IFN-γ受体
E. 受IL-12和IFN-γ的作用

正确答案：A。TCR识别Ag肽-自身MHCⅠ类分子复合物